急性弥漫性增生性肾小球肾炎中增生的主要细胞是
A. 肾小球周围的成纤维细胞及系膜细胞
B. 肾球囊壁层上皮细胞及毛细血管内皮细胞
C. 肾小球毛细血管内皮细胞及系膜细胞
D. 肾球囊脏层上皮细胞及系膜细胞
E. 肾球囊脏层上皮细胞及壁层上皮细胞

正确答案：C。肾小球毛细血管内皮细胞及系膜细胞

解析：急性弥漫性增生性肾小球肾炎中增生的主要细胞是毛细血管内皮细胞和系膜细胞（C对）。现将常见的肾小球肾炎病变特征总结如下：1、急进性肾炎：肾小球壁层上皮细胞增生，新月体形成；2、膜性肾小球病：肾小球毛细血管壁弥漫性增厚，钉突形成；3、微小病变性肾小球病：弥漫性肾小球脏层上皮细胞足突消失；局灶节段性肾小球硬化：肾小球的部分小叶硬化；4、膜增生性肾小球肾炎：肾小球基膜增厚、肾小球细胞增生和系膜基质增多；5、系膜增生性肾小球肾炎：弥漫性系膜细胞增生及系膜基质增多；6、IgA肾病：系膜增生性病变，也可表现为局灶节段性增生或硬化；7、慢性肾小球肾炎：大量肾小球发生玻璃样变和硬化（ABDE不符合任意一种肾炎病理改变，ABDE均错）。